关于发热的用药指导与患者教育的说法，下列说法正确的有
A. 解热镇痛药用于退热只是对症治疗，并不能解除病因
B. 非选择性非甾体抗炎药无明显的胃肠道刺激作用
C. 使用退热药后，如发热症状无好转，应及时就诊
D. 肝肾功能不全者，要减少解热镇痛药剂量
E. 血小板减少及有出血倾向者，应慎用非甾体抗炎药

正确答案：A、C、D、E。解热镇痛药用于退热只是对症治疗，并不能解除病因；使用退热药后，如发热症状无好转，应及时就诊；肝肾功能不全者，要减少解热镇痛药剂量；血小板减少及有出血倾向者，应慎用非甾体抗炎药

解析：本题考查发热的用药指导与患者教育。解热镇痛药用于退热只是对症治疗，并不能解除病因（A对）。为避免药物对胃肠道的刺激，布洛芬等非选择性非甾体抗炎药宜在餐后服药（B错）（肠溶制剂则宜空腹或餐后2小时服用），不宜空腹服药。老年人、肝肾功能不全者、血小板减少症者、有出血倾向者、有上消化道出血或穿孔病史者，应减量慎用（DE对）。解热镇痛药用于退热一般不超过3天，如症状未缓解应及时就医（C对），不得自行长期服用。